医技工作的特点不包括
A. 科室的专业性
B. 服务的广泛性
C. 与临床科室的协同性
D. 设备的使用与管理的一体性
E. 自身防护与社会防护的独立性

正确答案：E。自身防护与社会防护的独立性